肠道菌群是
A. 定居在人体中菌群的集合
B. 定居在人消化道中菌群的集合
C. 暂居在人体中菌群的集合
D. 暂居在人肠道中菌群的集合
E. 暂居在人消化道中菌群的集合

正确答案：B。定居在人消化道中菌群的集合

解析：与肠道菌群的关系：肠道菌群是定居在人消化道中菌群的集合。掌握“黏膜免疫”知识点。